腹胀满，无压痛，叩之作空声，可见于
A. 水臌
B. 气胀
C. 痰饮
D. 积聚
E. 内痈

正确答案：B。气胀

解析：气胀属鼓胀的一类，气胀为一手轻轻叩拍腹壁，另一手无波动感，以手叩击如击鼓之膨膨然，腹胀满却无压痛，叩之有空声（B对）。水鼓也属于鼓胀的一类，一手轻轻叩拍腹壁，另一手有波动感，按之如囊裹水者（A错）。胃中有痰饮者，脘部按之有形而胀痛，推之辘辘有声（C错）。凡腹部肿块推之不移，肿块痛有定处者，为积，病属血分；肿块推之可移，或痛无定处，聚散不定者，为聚，病属气分（D错）。腹部肿胀拒按着，多为内痈（E错）。